根据九届全国人大一次会议通过的国务院机构改革方案，中共中央、国务院决定成立直属国务院的
A. 国家药品监督管理局
B. 国家药品监督局
C. 国家药品管理局
D. 国家药品质量监督局
E. 国家药品质量监督管理局

正确答案：A。国家药品监督管理局

解析：本题考查国家药品监督管理局。根据九届全国人大一次会议通过的国务院机构改革方案，中共中央、国务院决定成立直属国务院的国家药品监督管理局（A对）。1998年，我国进行了第四次行政管理体制改革。此次改革的重要措施之一是，将原卫生部下属的药政管理局和原国家经贸委管理的医药管理局合并，组建国家药品监督管理局，为国务院直属机构，负责对药品（含医疗器械）研究、生产、流通、使用全过程的监督管理，药品集中统一监管体制正式建立。